右上2缺失，以右上3为基牙设计单端固定桥的条件是
A. 右上2缺隙大
B. 右上3牙槽骨吸收超过根长1/3
C. 右上2缺隙小力不大
D. 患者（牙合）力过大
E. 右上3牙冠短小

正确答案：C。右上2缺隙小力不大

解析：本题考查单端固定桥的适用。单端固定桥由于基牙易受扭力、易倾斜，使牙周组织损伤，故通常仅用于缺隙小力不大（C对AD错）的前牙。在选择基牙时，牙槽骨吸收最多不超过根长的1/3（B错）。基牙牙冠短小（E错）时由于不能提供较强的固位力也不适宜设计单端固定桥。